6岁的娟娟今年9月入学成了一名小学生。上学的第1周，她总是在课堂上低头玩弄小手绢，老师便不断提醒她，“娟娟，抬头看黑板”。第2周娟娟就能认真听讲了。可是到了学期末，她时常在课堂上做小动作，学习效率降低。在课堂上做小动作表明娟娟出现了
A. 疲倦
B. 早期疲劳
C. 显著疲劳
D. 过度劳累
E. 厌学情绪

正确答案：B。早期疲劳